体内代谢产物仍具活性，且作用时间较长的是
A. 盐酸吗啡
B. 盐酸哌替啶
C. 枸橼酸芬太尼
D. 盐酸美沙酮
E. 盐酸溴己新

正确答案：D。盐酸美沙酮

解析：本题考查氨基酮类镇痛药。体内代谢产物仍具活性，且作用时间较长的是盐酸美沙酮（D对）。盐酸美沙酮经代谢生成美沙醇，美沙醇镇痛活性弱于原药，再经代谢成去甲美沙醇和二去甲美沙醇，半衰期比美沙酮长，镇痛作用较长。盐酸吗啡（A错）主要经肝脏代谢，代谢产物为吗啡-6-葡萄糖醛酸，仍然有药理活性，但作用时间不长。盐酸哌替啶（B错）主要在肝内代谢为哌替啶酸和去甲哌替啶，哌替啶酸无镇痛活性，去甲哌替啶体消除很慢，易蓄积产生中枢毒性，引发癫痫。枸橼酸芬太尼（C错）在肝脏中代谢成无活性的代谢产物。溴己新（E错）分子在体内可发生环己烷羟基化、N-去甲基的代谢得到活性代谢物氨溴索，氨溴索为黏液溶解药，可用于急、慢性支气管炎及支气管哮喘、支气管扩张、肺气肿、肺结核、肺尘埃沉着病、手术后的咳嗽困难等。